口腔颌面部损伤防治感染的措施中，正确的是
A. 无清创条件时，应尽早包扎创口，防止细菌继续侵入
B. 预防破伤风，伤后应及时注射破伤风抗毒素
C. 伤后应及早使用广谱抗生素
D. 动物咬伤应预防性注射狂犬病疫苗
E. 以上均正确

正确答案：E。以上均正确

解析：口腔颌面部损伤的创口常被细菌和尘土等污染，易致感染而增加损伤的复杂性和严重性，颌面战伤创口的感染率更高，约为20%。防治感染是初期急救中的重要问题。尽早清创是最重要的手段之一，在有条件时，应尽早进行清创缝合术；无清创条件时，应尽早包扎创口，防止外界细菌继续侵入。伤后应及早使用广谱抗生素。为了预防破伤风，伤后应及时注射破伤风抗毒素；动物咬伤应预防性注射狂犬病疫苗以预防狂犬病的发生。掌握“口腔颌面部创伤急救”知识点。